颞间隙借脂肪结缔组织可与下列哪个间隙相通
A. 颊间隙
B. 颞下间隙
C. 咬肌间隙
D. 翼下颌间隙
E. 以上均正确

正确答案：E。以上均正确

解析：颞间隙位于颧弓上方的颞区，借颞肌分为颞浅与颞深两间隙：借脂肪结缔组织与颞下间隙、咬肌间隙、翼下颌间隙和颊间隙相通。掌握“颞间隙、咽旁间隙感染”知识点。